伴有神经症状的巨幼细胞性贫血患者，在补充叶酸的基础上，还应补充
A. 维生素B₁
B. 维生素B₂
C. 维生素B₄
D. 维生素B₆
E. 维生素B₁₂

正确答案：E。维生素B₁₂

解析：本题考查治疗巨幼红细胞性贫血的药物。伴有神经症状的巨幼细胞性贫血患者，在补充叶酸的基础上，还应补充维生素B₁₂（E对）。维生素B₆（D错）主要用于脂溢性皮炎、异烟肼、青霉胺等药物中毒引起的维生素B₆缺乏，也可用于妊娠呕吐及放疗和化疗抗肿瘤所致的呕吐。